高效、高选择性的HIV蛋白酶抑制剂是
A. 阿昔洛韦
B. 拉米夫定
C. 依法韦仑
D. 奥司他韦
E. 沙奎那韦

正确答案：E。沙奎那韦

解析：本题考查抗艾滋病病毒药的分类。常用的HIV蛋白酶抑制剂包括沙奎那韦（E对）和利托那韦。